能引起人畜共患病的病原体是
A. 梅毒螺旋体
B. 霍乱弧菌
C. 布氏杆菌
D. 淋球菌
E. 白喉杆菌

正确答案：C。布氏杆菌

解析：布氏杆菌为动物源性细菌，以动物为传染源，是能引起动物和人类发生人兽共患病的病原体（C对）。梅毒螺旋体（A错）只感染人类引起梅毒，梅毒患者是唯一的传染源（P202）。霍乱弧菌（B错）主要通过污染的水源或食物传播，可导致人类轻型腹泻甚至是严重致死性腹泻，在自然情况下，人类是霍乱弧菌的唯一易感者（P124）。淋球菌（淋病奈瑟菌）（D错）引起人类泌尿生殖系统黏膜化脓性感染，是一种性传播疾病，人类是淋球菌的唯一宿主（P105）。白喉杆菌（E错）主要引起人类急性呼吸道传染疾病即白喉（P164）。